可溶于pH9～10的NH4OH水溶液中的生物碱有
A. 小檗碱
B. 汉防己甲素
C. 药根碱
D. 轮环藤酚碱
E. 莨菪碱

正确答案：A、C、D。小檗碱；药根碱；轮环藤酚碱